呈不规则结节状拳形团块，有特异浓郁香气的药材是
A. 黄精
B. 地黄
C. 白蔹
D. 川芎
E. 莪术

正确答案：D。川芎

解析：本题考查的是川芎药材的性状鉴别。呈不规则结节状拳形团块，有特异浓郁香气的药材是川芎（D对）。川芎：【性状鉴别】药材呈不规则结节状拳形团块。表面黄褐色或褐色，粗糙皱缩，有多数平行隆起的轮节，顶端有凹陷的类圆形茎痕，下侧及轮节上有多数小瘤状根痕。质坚实，不易折断，断面黄白色或灰黄色，可见波状环纹（形成层）及错综纹理，散有黄棕色小油点（油室）。气浓香，味苦、辛，稍有麻舌感、微回甜。黄精（A错）：【性状鉴别】药材大黄精呈肥厚肉质的结节块状。表面淡黄色至黄棕色，具环节，有皱纹及须根痕，结节上侧茎痕呈圆盘状，周围凹入，中部突出。质硬而韧，不易折断，断面角质，淡黄色至黄棕色。气微，味甜，嚼之有黏性。地黄（B错）：【性状鉴别】药材鲜地黄呈纺锤形或条状。外皮薄，表面浅红黄色，具弯曲的纵皱纹、芽痕、横长皮孔样突起以及不规则疤痕。肉质、易断，断面皮部淡黄白色，可见橘红色油点，木部黄白色，导管呈放射状排列。气微，味微甜、微苦。莪术（E错）：【性状鉴别】药材蓬莪术呈卵圆形、长卵形、圆锥形或长纺锤形，顶端多钝尖，基部钝圆。表面灰黄色至灰棕色，上部环节突起，有圆形微凹的须根痕或有残留的须根，有的两侧各有1列下陷的芽痕和类圆形的侧生根茎痕，有的可见刀削痕。体重，质坚实。断面灰褐色至蓝褐色，蜡样，常附有灰棕色粉末，皮层与中柱易分离，内皮层环纹棕褐色。气微香，味微苦而辛。白蔹（C错）药材的性状鉴别，2022年考试指南未明确说明。